刮治器工作端进入牙周袋的角度
A. 0°
B. 50°
C. 45°
D. 80°
E. 90°

正确答案：A。0°

解析：本题考查慢性牙周炎的治疗原则、程序及方法。刮治器的工作面呈0°角（A对）进入袋底，即刮治器工作端进入牙周袋时工作面与根面平行，轻轻放入袋底处牙石的基底部。